原尿返漏是由于
A. 肾小管阻塞
B. 原尿流速缓慢
C. 肾小管完整性破坏
D. 肾间质压力降低
E. 尿量减少

正确答案：C。肾小管完整性破坏

解析：在持续肾缺血和肾毒物作用下，肾小管完整性破坏（C对）形成原尿返漏。